10～20/高倍视野，血Alb18g/L，Cr79mol/L，ANA（-），乙型肝炎病毒标志物均（-）。如果经足量糖皮质激素治疗12周无效。其病理类型最可能是
A. 毛细血管内增生性肾小球肾炎
B. 膜增生性肾小球肾炎
C. 膜性肾病
D. 局灶节段性肾小球硬化
E. 微小病变型肾病

正确答案：B。膜增生性肾小球肾炎

解析：青年男性患者，尿蛋白12.2g/d（正常≤0.15g/d，提示有大量蛋白尿），血Alb18g/L（白蛋白正常为40～55g/L，提示有低白蛋白血症），双下肢及颜面水肿1周（提示有明显水肿），大量蛋白尿、低白蛋白血症、明显水肿是肾病综合征的基础表现。经足量糖皮质激素治疗12周无效，其病理类型最可能是系膜毛细血管性肾小球肾炎（又称膜增生性肾小球肾炎）（B对）。因本病所致肾病综合征治疗困难，糖皮质激素仅对部分儿童病例有效，对青年患者一般疗效较差。毛细血管内增生性肾小球肾炎（A错）多表现为急性肾炎综合征，通常有咽部等处感染史。膜性肾病（P473）（C错）约20%～35%患者的临床表现可自发缓解，约60%～70%的早期患者经糖皮质激素和细胞毒药物治疗后可达临床缓解。局灶节段性肾小球硬化（P472）（D错）糖皮质激素治疗约半数患者有效，只是起效慢，平均缓解期约4个月。微小病变型肾病（P471）（E错）患者激素治疗效果好，2周左右开始起效，最终可达临床完全缓解。